某男，72岁，患前列腺增生症10年，症见腰膝酸软，尿频、尿急、尿痛、尿线细，伴小腹拘急疼痛证属肾气不足、湿热瘀阻所致的癃闭。治当益肾活血、清热通淋，宜选用的成药是
A. 癃清片
B. 三金颗粒
C. 八正合剂
D. 癃闭舒胶囊
E. 萆薢分清丸

正确答案：D。癃闭舒胶囊

解析：本题考查的是癃闭舒胶囊的主治。患前列腺增生症10年，症见腰膝酸软，尿频、尿急、尿痛、尿线细，伴小腹拘急疼痛证属肾气不足、湿热瘀阻所致的癃闭。治当益肾活血、清热通淋，宜选用的成药是癃闭舒胶囊（D对）。癃闭舒胶囊：【主治】肾气不足、湿热瘀阻所致的癃闭，症见腰膝酸软、尿频、尿急、尿痛、尿线细，伴小腹拘急疼痛；前列腺增生症见上述证候者。癃清片（A错）：【主治】下焦湿热所致的热淋，症见尿频、尿急、尿痛、腰痛、小腹坠胀。亦用于慢性前列腺炎之湿热蕴结兼瘀血证，症见小便频急，尿后余沥不尽，尿道灼热，会阴少腹腰骶部疼痛或不适等。三金片（B错）：【主治】下焦湿热所致的热淋，症见小便短赤、淋沥涩痛、尿急频数；急性肾盂肾炎、慢性肾盂肾炎、膀胱炎、尿路感染见上述证候者；慢性非细菌性前列腺炎肾虚湿热下注证。八正合剂（C错）：【主治】湿热下注所致的淋证，症见小便短赤、淋沥涩痛、口燥咽干等。萆薢分清丸（E错）：【主治】肾不化气、清浊不分所致的白浊、小便频数。